在进行颌面部包扎时颏部包扎过紧会引起
A. 组织移位
B. 血液循环不良
C. 呼吸不畅
D. 血流不止
E. 以上都不是

正确答案：B。血液循环不良

解析：包扎颌面部时应注意松紧度适当。不要压迫颈部以免影响呼吸，颏部不要过紧以免影响皮肤血液循环不良，引起水疱。掌握“口腔颌面部创伤急救”知识点。